男，72岁，1小时前睡眠时突发胸痛、呼吸困难，伴出汗。救护车到后心电图检查Ⅱ、Ⅲ、avf导联ST段弓背向上抬高0.3mv。查体体温36.5℃，心率正常，血压115/75mmHg，去往医院途中症状缓解。复测心电图Ⅱ、Ⅲ、avf导联ST恢复到等电位线。入院后反复复查肌钙蛋白正常。考虑诊断为
A. 变异型心绞痛
B. 急性下壁心肌梗死
C. 急性心包炎
D. 劳力性心绞痛
E. 不稳定型心绞痛

正确答案：A。变异型心绞痛

解析：该患者男，72岁，在睡眠时出现突发的胸痛、呼吸困难，伴出汗。救护车到后心电图检查Ⅱ、Ⅲ、avf导联ST段弓背向上抬高0.3mv（变异型心绞痛的心电图特点）。查体体温36.5℃，心率正常，血压115/75mmHg，去往医院途中症状缓解。复测心电图Ⅱ、Ⅲ、avf导联ST恢复到等电位线（变异型心绞痛的心电图特点）。入院后反复复查肌钙蛋白正常，一过性ST段动态改变，考虑诊断为变异型心绞痛（A对）。